O型血所含的的抗原是
A. A抗原
B. H抗原
C. O抗原
D. B抗原
E. MHC抗原

正确答案：B。H抗原

解析：（P81）在A基因的控制下，细胞合成的A酶能使一个N-乙酰半乳糖胺基连接到H物质上，形成A抗原（A错）;而在B基因控制下合成的B酶，则能把一个半乳糖基连接到H物质上，形成B抗原（D错），B型血所含的抗原为B抗原；O型红细胞虽然不含A、B抗原，但有H抗原（B对C错）；MHC（E错）为主要组织相容性复合体，是一组与免疫应答密切相关、决定移植组织是否相容、紧密连锁的基因群。